患者，男，40岁，无基础疾病，拟行甲状腺切除术，术前半小时使用头孢噻肟钠预防感染。对该用药的评价，正确的是
A. 不宜选用头孢噻肟钠，应选用头孢唑林钠
B. 不宜选用头孢噻肟钠，应选用青霉素钠
C. 不宜在术前半小时用药，应在术中用药
D. 不宜在术前半小时用药，应在术后用药
E. 不必使用抗菌药物，属无指征用药

正确答案：E。不必使用抗菌药物，属无指征用药

解析：本题考查头孢噻肟钠的用药评价。对该药的用药评价正确的是：不必使用抗菌药物，属无指征用药（E对）。无指征用药是指非细菌感染，但在临床上无明显感染指征常被给于抗菌药物。如Ⅰ类手术切口应用第三代头孢菌素。甲状腺切除术为Ⅰ类手术切口，为无菌切口。又因该患者无基础疾病，所以不必使用抗菌药物，故本题选择无指征用药。